哪项表现对诊断尿路感染最有意义
A. 畏寒、发热、白细胞增高
B. 尿频、尿急、尿痛
C. 尿培养细菌计数105/ml
D. 清洁中段尿白细胞5个/视野
E. 尿亚硝酸盐还原试验阳性

正确答案：C。尿培养细菌计数105/ml

解析：真性菌尿的标准：①新鲜中段尿沉渣革兰氏染色油镜观察，细菌＞1个/视野；②新鲜中段尿细菌培养计数≥105/ml；③膀胱穿刺尿培养阳性。掌握“急性肾孟肾炎、尿路结石及慢性肾衰竭”知识点。